劳动能力鉴定是指
A. 健康监护分析的结果
B. 对生产劳动者作业能力的分析
C. 对生产劳动者能力的确定
D. 对生产劳动者能力的评定
E. 对生产劳动者能力的确定和评价

正确答案：E。对生产劳动者能力的确定和评价